在胆汁中排出的药物或代谢物，在小肠中转运期间重新吸收返回门静脉的现象
A. 肠肝循环
B. 首过效应
C. 胃排空速率
D. 吸收
E. 分布

正确答案：A。肠肝循环

解析：本题考查肝肠循环。肠肝循环（A对）是指随胆汁排入十二指肠的药物或其代谢物，在肠道中重新被吸收，经门静脉返回肝脏，重新进入血液循环的现象；首过效应（B错）是指口服药物在胃肠道吸收，在进入血液循环之前被代谢，使进入血液循环的原形药量减少的现象；胃排空速率（C错）为胃排空的快慢；吸收（D错）是药物从给药部位进入体循环的过程；分布（E错）是指药物进入体循环后向各组织、器官或者体液转运的过程。